牙解剖外形中，外形高点在中1/3处的是
A. 前牙唇颊侧
B. 上尖牙唇侧
C. 磨牙唇颊侧
D. 前牙舌侧
E. 磨牙舌侧

正确答案：E。磨牙舌侧

解析：本题考查牙体解剖的常用词。牙解剖外形中，外向高点在中1/3处的是磨牙舌侧（E对）。后牙的外形高点颊侧一般在牙冠颈1/3、舌侧一般在牙冠中1/3（B错）。前牙的外形高点一般均在牙冠颈1/3（ACD错）。